尺神经
A. 经腕管入手掌
B. 于尺神经沟处位置最深
C. 含颈5~胸l脊神经前支纤维
D. 自臂丛外侧束分出
E. 尺神经掌支在豌豆骨外侧分浅、深两支

正确答案：E。尺神经掌支在豌豆骨外侧分浅、深两支

解析：尺神经自臂丛内侧束发出后（D错），从腋动、静脉之间穿出腋窝，在肱二头肌内侧沟伴行于肱动脉内侧至臂中部，含C8和T1的脊神经前支（C错）。尺神经在桡腕关节上方尺神经发出手背支后，主于在豌豆骨桡侧，屈肌支持带浅面分为浅支和深支（E对），在掌腱膜深面、腕管浅面进入手掌（A错）。